硬脂醇为
A. 溶蚀性骨架材料
B. 亲水凝胶型骨架材料
C. 不溶性骨架材料
D. 渗透泵型控释片的半透膜材料
E. 常用的植入剂材料

正确答案：A。溶蚀性骨架材料

解析：本题考查骨架型缓释材料。溶蚀性骨架材料（A对）是指疏水性强的脂肪类或蜡类物质，如动物脂肪、蜂蜡、巴西棕榈蜡、氢化植物油、硬脂醇、单硬脂酸甘油酯、硬脂酸丁酯等。亲水凝胶型骨架材料（B错）有羧甲基纤维素钠、甲基纤维素、羟丙甲纤维素、聚维酮、卡波姆、海藻酸盐、壳聚糖等；不溶性骨架材料（C错）有聚甲基丙烯酸酯、乙基纤维素、聚乙烯、无毒聚氯乙烯、乙烯-醋酸乙烯共聚物、硅橡胶等；渗透泵型控释片的半透膜材料（D错）有纤维素类、聚乙烯醇类、聚丙烯酸树脂类等；植入剂的骨架材料（E错）一般用生物不降解材料硅橡胶。